人类胚胎干细胞研究和应用的伦理准则应除外
A. 尊重的准则
B. 知情同意的准则
C. 研究无禁区的准则
D. 安全有效的准则
E. 防止商品化的准则

正确答案：C。研究无禁区的准则

解析：人类胚胎干细胞研究和应用的伦理准则包括尊重的准则、知情同意的准则、安全有效的准则、防止商品化的准则四方面内容。请您记忆！该题目较易解答，均为固定知识点，C.研究无禁区的准则为干扰项，且教材中并未提及。掌握“人类胚胎干细胞及基因诊疗的伦理”知识点。